下列除哪项外，均有脉率快的特点
A. 数
B. 促
C. 滑
D. 疾
E. 动

正确答案：C。滑

解析：根据脉象的特点，将脉象可分为浮、沉、迟、数、虚、实六大类，其中数脉类的共同特点为一息五至以上，脉率快，数脉类有数、疾、促、动脉，均脉率快，滑脉属实脉类。数脉一息五至以上，不足七至（A错）。促脉数而时一止，止无定数（B错）。滑脉往来流利，应指圆滑，如盘走珠（C对）。疾脉脉来急疾，一息七八至（D错）。动脉脉短如豆，滑数有力（E错）。